关于铬污染不正确的是
A. 土壤铬污染主要来自铬矿和金属冶炼、电镀、制革等工业废水、废气、废渣及含铬工业废水灌溉
B. 铬在土壤环境中主要以三价铬和六价铬等形式存在
C. 三价铬因毒性较强，比六价铬毒性大100倍
D. 铬在人体内有蓄积作用，体内过量的铬主要积聚在肝、肾、内分泌腺体
E. 三价铬主要存在于土壤与沉积物中，六价铬主要存在于水中

正确答案：C。三价铬因毒性较强，比六价铬毒性大100倍

解析：本题考查铬污染。土壤铬污染主要来自铬矿和金属冶炼、电镀、制革等工业废水、废气、废渣及含铭工业废水灌溉（A对）。铬在人体内有蓄积作用，体内过量的铬主要积聚在肝、肾、内分泌腺体（D对）。铬在土壤环境中主要以三价铬和六价铬等形式存在（B对），三价铬主要存在于土壤与沉积物中，六价铬主要存在于水中（E对）。六价铬因具有强氧化性和腐蚀性，又有透过生物膜的作用，容易进入细胞内对人体有很强的毒性作用，其毒性比三价铬毒性大100倍（C错，为本题正确答案）。